治疗急性胃炎胃络瘀阻证，首选
A. 香苏散合良附丸加减
B. 清中汤加减
C. 保和丸加减
D. 柴胡疏肝散加减
E. 失笑散合丹参饮加减

正确答案：E。失笑散合丹参饮加减

解析：急性胃炎胃络瘀阻治法当以化瘀通络，和胃止痛，方用失笑散合丹参饮加减（E对）。香苏散合良附丸加减治疗寒邪客胃证（A错）。清中汤加减治疗湿热中阻证（B错）。保和丸治疗食积气滞证（C错）。柴胡疏肝散加减治疗肝胃不和证（D错）。